吸收入血5价砷最易蓄积的组织是
A. 神经组织
B. 脂肪组织
C. 结缔组织
D. 肝、肾、肺、脾
E. 骨组织

正确答案：E。骨组织

解析：本题考查吸收入血五价砷最易蓄积的组织。五价砷主要以砷酸盐的形式取代骨组织中磷灰石的磷酸盐，从而蓄积于骨组织（E对ABCD错）中。